急性牙槽脓肿是指
A. 根尖肉芽肿
B. 根尖周炎急性浆液期
C. 根尖周炎急性化脓期
D. 急性牙周膜炎
E. 牙周脓肿

正确答案：C。根尖周炎急性化脓期

解析：本题考查急性化脓性根尖周炎。急性根尖周炎可分为急性浆液性根尖周炎和急性化脓性根尖周炎，急性化脓性根尖周炎又称为急性牙槽脓肿（C对B错）；慢性根尖周可分为根尖周肉芽肿（A错）、慢性根尖周脓肿、根尖周囊肿、根尖周致密性骨炎。急性牙周膜炎为急性根尖周炎或牙周脓肿等可使牙明显松动，因牙周膜充血水肿及渗出所致（D错）。牙周脓肿是牙周炎发展到晚期，出现深牙周袋后的一个常见症状（E错）。